高血压可使用的药物是
A. 呋塞米
B. 氨苯蝶啶
C. 乙酰唑胺
D. 氢氯噻嗪
E. 螺内酯

正确答案：D。氢氯噻嗪

解析：本题考查氢氯噻嗪的临床应用。临床上常用的抗高血压药是氢氯噻嗪（D对）。氢氯噻嗪可单独与其他降压药联合应用，主要用于治疗原发性高血压。呋塞米（A错）为袢利尿剂，临床主要用于消除各种严重水肿、治疗急性肺水肿和脑水肿、预防急性肾衰竭、加速中毒药物排泄。氨苯蝶啶（B错）为留钾利尿剂，用于慢性心力衰竭、肝硬化腹水、肾病综合征、糖皮质激素治疗过程中发生的水钠涨留，特发性水肿，亦用于对氢氯噻嗪或螺内酯无效者。乙酰唑胺（C错）为碳酸酐酶抑制剂，临床用于治疗各种类型的青光眼及继发性青光眼降低眼压。螺内酯（E错）为醛固酮受体阻断剂，临床作为高血压治疗的辅助药物，也用于治疗水肿性疾病、原发性醛固酮增多症的治疗和诊断、与噻嗪类利尿剂合用，增强利尿效应和预防低钾血症等。